胆汁可促进
A. 钙铁的吸收
B. 蛋白质消化
C. 糖的吸收
D. 维生素A的吸收
E. 维生素B₁₂的吸收

正确答案：D。维生素A的吸收

解析：胆汁中的胆盐可以与脂溶性维生素A、D、E、K聚合形成水溶性混合微胶粒，混合微胶粒很容易穿过肠黏膜，从而促进维生素A、D、E、K的吸收（D对）。胃液可以促进钙铁吸收，维生素D可以促进钙吸收（A错）。胆汁中不含有任何消化酶，所以不能促进蛋白质消化（P206）（B错）。糖的吸收可被胰淀粉酶促进（C错）。内因子可以促进维生素B₁₂的吸收（E错）。